羚羊角具有的功效是
A. 平肝潜阳，软坚散结
B. 息风止痉，降逆止血
C. 平肝潜阳，清热解毒
D. 平肝潜阳，祛风止痛
E. 息风止痉，通络散结

正确答案：C。平肝潜阳，清热解毒

解析：该题考查羚羊角的功效，属记忆内容。羚羊角味咸，性寒；入肝、心经；具有平肝熄风，清肝明目，清热解毒的功效，本品味咸质重主降，有平肝潜阳之功（C对ABDE错）。